传播作为一个行为过程，包含着以下的必须要素，什么除外
A. 传播者
B. 信息
C. 传播途径
D. 接受者
E. 反馈

正确答案：E。反馈